关于微孔滤膜特点的错误表述是
A. 孔径小而均匀、截留能力强
B. 滤过时易产生介质脱落
C. 不影响药液的pH值
D. 滤膜吸附性小
E. 主要缺点为易于堵塞

正确答案：B。滤过时易产生介质脱落